氯贝丁酯中检查的特殊杂质是
A. 吗啡
B. 林可霉素B
C. 哌啶苯丙酮
D. 对氨基酚
E. 对氯酚

正确答案：E。对氯酚

解析：本题考查特殊杂质。氯贝丁酯中检查的特殊杂质是对氯酚（E对）。吗啡（A错）是磷酸可待因的特殊杂质。林可霉素B（B错）是盐酸林可霉素的特殊杂质。哌啶苯丙酮（C错）是盐酸苯海索的特殊杂质。对氨基酚（D错）是对乙酰氨基酚的特殊杂质。